患者，女，19岁。半月前无意中发现颈部粗大，无异常不适。颈部呈弥漫性肿大，边缘不清，皮色不变，无触痛，并可扪及数个大小不等的结节，随吞咽动作而上下移动。具体诊断是
A. 气瘿
B. 石瘿
C. 肉瘿
D. 瘿痈
E. 颈痈

正确答案：A。气瘿

解析：气瘿的临床特点为女性发病率较男性略高。一般多发生在青春期，初起时无明显不适感，甲状腺呈弥漫性肿大，腺体表面较平坦，质软不痛，皮色如常，腺体随吞咽动作而上下移动，题中患者符合气瘿的诊断（A对）。石瘿的临床特点为结喉两侧结块，生长迅速，质地坚硬如石，表面凹凸不平，推之不移，并可出现吞咽受限，可伴疼痛，题中质地不硬，吞咽无受限（B错）。肉瘿的临床特点为颈前喉结一侧或两侧结块，柔韧而圆，如肉之团，随吞咽动作而上下移动，边界清楚，题中为结节，且边界不清（C错）。瘿痈的临床特点为结喉两侧结块，色红灼热，疼痛肿胀，甚至化脓，疼痛可牵引至耳后枕部，活动或吞咽时加重，常伴发热、头痛等症状，题中无发热、头痛，吞咽时无疼痛加重，无触痛（D错）。颈痈为生于颈部两侧或耳后、项下、颏下的急性化脓性疾病，初起局部肿胀、灼热、疼痛，具有明显的风温外感症状。题中患者无风温外感症状，无触痛（E错）。